下列哪项属新生儿的正常舌象
A. 舌红无苔
B. 舌红少津
C. 舌质绛红
D. 舌生红刺
E. 舌质淡白

正确答案：A。舌红无苔

解析：新生儿尚未进食，胃气尚未启发，故见舌红无苔（A对）。舌红少津可见于阴虚火旺（B错）。舌质绛红，舌有红刺可见于热入营血（CD错）。舌质淡白为气血虚亏（E错）。